白血病龈病损表现为
A. 龈增生呈细小分叶状、球状
B. 牙龈肿大颜色暗红发绀或苍白，龈缘处组织坏死、溃疡
C. 龈乳头呈球样增生、质软多见于前牙唇侧
D. 增生牙龈覆盖牙冠，质地坚韧，颜色正常或发白
E. 龈肥大、淡粉色，质硬

正确答案：B。牙龈肿大颜色暗红发绀或苍白，龈缘处组织坏死、溃疡

解析：本题考查白血病的牙龈病损。白血病的牙龈病损表现为牙龈肿大颜色暗红发绀或苍白，龈缘处组织坏死、溃疡（B对）。白血病的牙龈病损可波及龈乳头、龈缘和附着龈。主要表现为：①牙龈肿大，颜色暗红发绀或苍白，组织松软脆弱或中等硬度，表面光亮。牙龈肿胀常为全口性，且可覆盖部分牙面。由于牙龈肿胀、菌斑堆积，牙龈一般有明显的炎症。②由于牙龈中大量幼稚血细胞浸润积聚，可造成末梢血管栓塞，局部组织对感染的抵抗力降低，使龈缘处组织坏死、溃疡和假膜形成，状如坏死性溃疡性龈炎，严重者坏死范围广泛，有口臭。③牙龈有明显的出血倾向，龈缘常有渗血，且不易止住，牙龈和口腔黏膜上可见出血点或淤斑。患者常因牙龈肿胀、出血不止或坏死疼痛而首先到口腔科就诊。及时检查血象有助于诊断。④严重的患者还可出现口腔黏膜的坏死或剧烈的牙痛（牙髓腔内有大量幼稚血细胞浸润引起）、发热、局部淋巴结肿大以及疲乏、贫血等症状。龈增生呈细小分叶状、球状（A错）为牙龈瘤。龈乳头呈球样增生、质软多见于前牙唇侧（C错）多为妊娠期龈炎。增生牙龈覆盖牙冠，质地坚韧，颜色正常或发白（D错）为遗传性牙龈纤维瘤病。龈肥大、淡粉色，质硬（E错）为药物性牙龈肥大。